判断早期宫内妊娠最准确的是
A. B超检查
B. 停经史
C. 黄体酮试验
D. 尿妊娠试验
E. 黑加征阳性

正确答案：A。B超检查

解析：判断早期宫内妊娠最准确的是B超检查（A对），能确定宫内妊娠，排除异位妊娠和滋养细胞疾病。停经史（B错）、黑加征阳性（E错）均为早期妊娠的临床表现；尿妊娠试验（D错）可有假阳性或假阴性，阳性结果需结合临床表现才可以诊断为妊娠，三者均不能独立作为诊断早期妊娠的依据，更不能确保是宫内妊娠。黄体酮试验即孕激素试验（P355）（C错）用于区别闭经的原因。